某项计量指标仅以过高为异常，且资料呈偏态分布，则其95％参考值范围为
A. ＜P95
B. ＜P97.5
C. ＞P5
D. P2.5～P97.5
E. P5～P95

正确答案：A。＜P95

解析：本题考查医学参考值范围的相关内容。因该资料呈偏态分布，且该项计量指标指标仅以过高异常时，其95%参考值范围单侧上限为＜P95(A对BCDE错）。